上消化道出血最常见的原因是
A. 胃癌
B. 消化性溃疡
C. 胃黏膜脱垂
D. 急性糜烂出血性胃炎
E. 肝硬化食管胃底静脉曲张

正确答案：B。消化性溃疡

解析：上消化道出血病因以消化性溃疡最常见（B对），约占所有病因的50%。肝硬化食管胃底静脉曲张破裂出血占20%-25%（E错）。急性糜烂性出血性胃炎占20%（D错），最近几年有增长趋势。胃癌导致上消化道出血占3%-5%（A错）。胃黏膜脱垂占不足10%（C错）。